关于手足口病临床表现说法错误的是
A. 所有病例均发热
B. 手掌或脚掌部出现斑丘疹
C. 皮疹特点为“四不特征”
D. 可伴有咳嗽、流涕
E. 臀部也可出现类似皮疹

正确答案：A。所有病例均发热